能接受光的剌激，并能转变为神经冲动的是
A. 脉络膜
B. 房水
C. 视锥细胞、视杆细胞
D. 双极神经元
E. 节细胞

正确答案：C。视锥细胞、视杆细胞

解析：能接受光的剌激，并能转变为神经冲动的是感光细胞，即视锥细胞、视杆细胞（C对）。